下列除哪项外，均为里实热证的表现
A. 身发高热
B. 两颧潮红
C. 口渴饮冷
D. 大汗不止
E. 脉象洪数

正确答案：B。两颧潮红

解析：血寒证指因内伤久病，阴液耗损而阳气偏亢者，多为虚热证，表现为潮热盗汗，两颧潮红（B错，为本题正确答案），大便秘结，舌红，脉细数等。因外感火热阳邪，或过服辛辣温热之品，或寒湿郁而化热，或七情过激，五志化火等导致体内阳热过盛，病势急骤，形体壮实者，多为实热证；热邪盛于脏腑，或因阴虚阳亢所致者，多为里热证。里实热证，由于阳热偏盛，津液被耗，故见发热（A对）恶热、面赤、大汗不止、舌红、苔黄、脉数等一派热象；热伤阴津，故见口渴饮冷（C对）、痰涕黄稠、小便短黄、大便干结、舌红少津等症。